以下关于感染创口的处理原则，下述错误的是
A. 感染创口的引流物一般应在无脓液排出48小时后去除
B. 感染创口应覆盖敷料，并定时检视和换药
C. 对肉芽组织创面及有大量脓性分泌物的创口，应予以湿敷
D. 有脓腔存在的创口，应以各种消毒及抗生素溶液冲洗脓腔
E. 颌骨骨髓炎患者创口拆线时间一般应在术后5天左右

正确答案：E。颌骨骨髓炎患者创口拆线时间一般应在术后5天左右

解析：感染创口的处理：①感染创口一般不应立即作初期缝合，应在感染被控制或进行手术清除病灶后考虑缝合。缝合时不宜过紧，组织不应太少，并常规放置引流物。引流物的去除应视有无脓性渗出而定，一般应在无脓液排出48小时后去除。②感染创口应覆盖敷料，并定时检视和换药，脓液多者可每天2次。③对肉芽组织创面及有大量脓性分泌物的创口，应予以湿敷。④有脓腔存在的创口，应保持引流通畅，并以各种消毒及抗生素溶液冲洗脓腔（药物选择原则与局部湿敷使用药物相同）。⑤感染创口经处理后缝合者（例如颌骨骨髓炎术后），由于组织炎性浸润变性，容易发生创口裂开，故不宜过早拆线，一般应在1周后。⑥感染创口在愈合过程中可根据具体情况，全身或局部应用抗生素，并加强营养支持和维生素摄入，促使创口早期愈合。掌握“口外创口处理”知识点。